碳酸锂的治疗剂量对正常人的影响
A. 精神紊乱
B. 反射亢进
C. 明显震颤
D. 发音困难
E. 无明显影响

正确答案：E。无明显影响

解析：碳酸锂主要是锂离子发挥药理作用，治疗剂量对正常人的精神行为没有明显的影响。掌握“丙米嗪、碳酸锂、氟西汀”知识点。